患者女，56岁，既往有高血压、高脂血症病史，长期服用依那普利片、阿托伐他汀钙片。现因上腹痛2周，伴黑便数日就诊。患者自诉3周前因膝关节痛，服用布洛芬，疼痛未缓解，自行加用萘普生。胃镜检查显示胃窦小弯侧有一约7mm溃疡，幽门螺杆菌(Hp）阳性。肾功能未见异常。该患者可能选用的Hp根除药物中，应餐前服用的是
A. 埃索美拉唑(艾司奥美拉唑）、克拉霉素
B. 埃索美拉唑(艾司奥美拉唑）、枸橼酸铋钾
C. 阿莫西林、克拉霉素
D. 枸橼酸铋钾、左氧氟沙星
E. 克拉霉素、甲硝唑

正确答案：B。埃索美拉唑(艾司奥美拉唑）、枸橼酸铋钾

解析：本题考查幽门螺杆菌感染方案。应餐前服用的是埃索美拉唑(艾司奥美拉唑）、枸橼酸铋钾（B对）。根除幽门螺杆菌感染的一线方案选择PPI+克拉霉素+阿莫西林+铋剂时，具体的给药方法为：埃索美拉唑20mgbid，餐前30min；枸橼酸铋钾0.6gbid，餐前30min；阿莫西林1.0gbid，餐后30min；克拉霉素500mgbid，餐后30min。